无屈膝作用的肌肉是
A. 缝匠肌
B. 股二头肌
C. 半腱、半膜肌
D. 比目鱼肌
E. 无

正确答案：D。比目鱼肌

解析：缝匠肌（A对）屈髋、屈膝关节，使已屈的膝关节旋内。股二头肌（B对）屈膝、伸髋关节，使已屈的膝关节旋外。半腱、半膜肌（C对）屈膝、伸髋关节，使已屈的膝关节旋内。比目鱼肌（D错，为本题正确答案）屈踝关节，而无屈膝关节。